某女，15岁。1月前因急性阑尾炎而住院手术治疗，刀口愈合良好。出院后出现便秘，4至5日排便1次。服通便西药乏效遂来求治，刻下除便秘外，又见食欲不佳，脘腹胀满，口干口苦饮水多，喜食凉酸之物，乏力，月经正常，舌红，苔薄白、微腻，脉滑数。证属热结便秘气滞湿阻。治以泻热通肠行气化湿。药用制大黄10g，枳实10g，瓜蒌30g，郁李仁12g（打碎），佩兰10g，陈皮10g，炒神曲12g，生白术10g。3剂，每日1剂水煎服。忌食辛辣油腻宜多食蔬菜。二诊，大便仍干，3日1行。纳增，脘胀减，食后嗳气，口微苦而干，舌红苔薄黄腻，脉弦滑。原方改制大黄为生大黄10g（后下），去郁李仁、炒神曲，加决明子30g（打碎），厚朴6g，炒莱菔子12g（打碎），清半夏10g，续进3剂。医师在方中投用佩兰，此因佩兰的药性与功效分别是
A. 性凉，化湿
B. 性平，化湿
C. 性温，化湿
D. 性微温，化湿
E. 性微寒，化湿

正确答案：B。性平，化湿

解析：本题考查的是佩兰的性味归经与功效。佩兰的药性与功效分别是性平，化湿（B对）。佩兰：【性味归经】辛，平。归脾、胃、肺经。【功效】化湿，解暑。砂仁：【性味归经】辛，温。归脾、胃经。【功效】化湿（C错）行气，温中止泻，安胎。广藿香：【性味归经】辛，微温。归脾、胃、肺经。【功效】化湿（D错），止呕，发表解暑。药性与功效为性凉，化湿（A错）或性微寒，化湿（E错）的中药，2022年考试指南未明确说明。